腺泡细胞癌是唾液腺恶性上皮性肿瘤，多见于
A. 小唾液腺
B. 舌下腺
C. 下颌下腺
D. 腮腺
E. 腭腺

正确答案：D。腮腺

解析：腺泡细胞癌是唾液腺恶性上皮性肿瘤，多见于腮腺，其次为小唾液腺、下颌下腺和舌下腺。掌握“腺泡细胞癌”知识点。